片按照厚度可分为极薄片、薄片、厚片等。因质地坚实，宜切薄片的中药是
A. 当归、甘草
B. 槟榔、白芍
C. 黄芪，三棱
D. 山药、茯苓
E. 乌药、南沙参

正确答案：B。槟榔、白芍

解析：本题考查饮片类型。1.片按照厚度可分为极薄片、薄片、厚片。极薄片的厚度要求为0.5mm以下；薄片的厚度要求为1～2mm；厚片的厚度要求为2～4mm。根据药材质地，一般质疏松宜厚，质密坚宜薄。质地极其致密坚实的木质类、动物骨和角类药材，宜切极薄片，如羚羊角、鹿角、降香等。质地致密、坚实者，宜切薄片，如乌药、槟榔、当归、白芍（B对）、三棱等。质地松泡、粉性大者，宜切厚片，如山药、天花粉、茯苓（D错）、甘草（A错）、黄芪（C错）、南沙参（E错）等。